HOAP方案常用于治疗
A. 急性粒细胞白血病
B. 急性淋巴细胞白血病
C. 慢性粒细胞白血病
D. 慢性淋巴细胞白血病
E. 慢性再生障碍性贫血

正确答案：A。急性粒细胞白血病

解析：HOAP方案，即三尖杉酯碱、阿霉素及泼尼松，为急性粒细胞性白血病的治疗方案（A对）。急性淋巴细胞白血病治疗方案为VP方案，即长春新碱（VCR）与泼尼松（P）联合用药（B错）。慢性粒细胞性白血病常用治疗药物为马利兰、靛玉红等（C错）。慢性淋巴细胞白血病常用瘤可宁治疗（D错）。慢性再生障碍性贫血常用雄激素等治疗（E错）。